不符合水痘皮疹特点的是
A. 皮疹呈向心性分布
B. 皮疹最初形态为斑丘疹
C. 黏膜处也可见皮疹
D. 丘疹、疱疹、结痂可同时存在
E. 皮疹不伴瘙痒

正确答案：E。皮疹不伴瘙痒